原形与代谢产物均具有抗抑郁作用的药物有
A. 舍曲林
B. 文拉法辛
C. 氟西汀
D. 帕利哌酮
E. 阿米替林

正确答案：A、B、C、E。舍曲林；文拉法辛；氟西汀；阿米替林

解析：本题考查抗抑郁药。原形与代谢产物均具有抗抑郁作用的药物有舍曲林（A对）、文拉法辛（B对）、氟西汀（C对）、阿米替林（E对）。抗抑郁药物有：1、去甲肾上腺素重摄取抑制剂。①二苯并氮䓬类如丙米嗪、氯米帕明；②二苯并庚二烯类如阿米替林及活性代谢产物去甲阿米替林；③二苯并噁嗪类如多塞平。2、5-羟色胺重摄取抑制剂。舍曲林的活性代谢产物N-去甲舍曲林，文拉法辛的活性代谢产物O-去甲文拉法辛，氟西汀的活性代谢产物去甲氟西汀，西酞普兰的活性代谢产物是N-去甲基西酞普兰。帕利哌酮（D错）是利培酮的活性代谢物，属于抗精神病药物。